中年女性，腹股沟韧带内侧的下外方突然出现包块，疼痛不能回纳，可能是
A. 腹股沟斜疝
B. 腹股沟直疝
C. 股疝
D. 睾丸鞘膜积液
E. 隐睾

正确答案：C。股疝

解析：疝囊通过股环，经股管向卵圆窝突出的疝，称股疝。股管是腹股沟韧带下内侧一个漏斗形的间隙，长约1～1.5cm，直径约1.5cm，有上、下口，上口为股环，有腹环隔膜覆盖，下口为卵圆窝，卵圆窝是股部阔筋膜上的一个薄弱部分，女性骨盆宽广，股管上口宽松，加上妊娠等因素，中年以上妇女易发生股疝（C对）。腹股沟斜疝（A错）多见儿童及青壮年，经腹股沟突出，由外上向内下前斜行进入阴囊，回纳疝块后压住内环疝块不再突出。腹股沟直疝（B错）多见于老年体弱者，经腹股沟三角直接由后向前突出，不进入阴囊，多呈半球形，基底部宽，回纳疝块后压住内环疝块仍突出。睾丸鞘膜积液主要表现为阴囊内逐渐增大肿物，一般无痛，有下坠感（D错）。隐睾主要表现为患侧阴囊扁平，单侧者左、右侧阴囊不对称，双侧隐睾阴囊空虚、瘪陷（E错）。